分子中含有巯基的血管紧张素转换酶抑制药是
A. 福辛普利
B. 依那普利
C. 赖诺普利
D. 喹那普利
E. 卡托普利

正确答案：E。卡托普利

解析：本题考查卡托普利。分子中含有巯基的血管紧张素转换酶抑制药是卡托普利（E对）。福辛普利（A错）是分子中含有膦酰基的血管紧张素转换酶抑制药。依那普利（B错）是分子中含双羧基的血管紧张素转换酶抑制药。赖诺普利（C错）是分子中含有游离双羧酸的血管紧张素转换酶抑制药。喹那普利（D错）是依那普利中的脯氨酸被四氢异喹啉羧酸所替代的药物。